格林－巴利综合征的典型临床表现之一为四肢远端
A. 感觉障碍比运动障碍明显
B. 感觉和运动障碍均十分严重
C. 仅有感觉障碍
D. 疼痛明显
E. 感觉障碍比运动障碍轻

正确答案：E。感觉障碍比运动障碍轻

解析：格林－巴利综合征（吉兰-巴雷综合征）（GBS）是一种自身免疫介导的周围神经病，主要损害多数脊神经根和周围神经，也常累及脑神经。典型临床表现有前驱感染史、急性起病、进行性加重、多在2周左右达高峰，首发症状多为肢体对称性迟缓性肌无力，感觉缺失较轻（B错）、呈手套-袜套样分布，四肢远端感觉障碍比运动障碍轻（E对A错）。格林－巴利综合征的典型临床表现除感觉障碍（C错）外还有运动障碍，无明显疼痛（D错）表现。